手太阳小肠经与足太阳膀胱经的交接部位在
A. 目内眦
B. 目外眦
C. 鼻根部
D. 胸中
E. 小指端

正确答案：A。目内眦

解析：同名的手、足阳经，在头面部交接-手太阳小肠经与足太阳膀胱经交接于目内眦（A对），手少阳三焦经与足少阳胆经交接于目外眦（B错），手阳明大肠经与足阳明胃经交接于鼻翼旁（C错）。相表里的阴经与阳经则在四肢末端交接，其中相表里的手三阴经与手三阳经交接于手指端，相表里的足三阳经和足三阴经交接在足趾端，如手少阴心经和手太阳小肠经在小指端交接（E错）。足少阴肾经与手厥阴心包经在胸中交接（D错）。